乡镇卫生院和社区卫生服务中心宣传栏不少于
A. 1个
B. 2个
C. 3个
D. 4个
E. 5个

正确答案：B。2个